维生素D₃的最高活性形式是
A. 24-（OH）D₃
B. 25-（OH）D₃
C. 1-（OH）D₃
D. 1，25-（OH）₂D₃
E. 24，25-（OH）₂D₃

正确答案：D。1，25-（OH）₂D₃